能够清除氧自由基
A. C-反应蛋白
B. 纤维连接蛋白
C. 白蛋白
D. 血浆铜蓝蛋白
E. α1-抗糜蛋白酶

正确答案：D。血浆铜蓝蛋白

解析：血浆铜蓝蛋白（D对）能够清除氧自由基。